既补肾益精又养阴润肺的是
A. 女贞子
B. 墨旱莲
C. 南沙参
D. 北沙参
E. 蛤蟆油

正确答案：E。蛤蟆油

解析：本题考查的是补阴药蛤蟆油的功效。既补肾益精又养阴润肺的是哈蟆油（E对）。蛤蟆油：【功效】补肾益精，养阴润肺。女贞子（A错）：【功效】滋肾补肝，清虚热，明目乌发。墨旱莲（B错）：【功效】滋阴益肾，凉血止血。南沙参（C错）：【功效】清肺养阴，祛痰，益气。北沙参（D错）：【功效】养阴清肺，益胃生津。